下列机制所致的低氧血症中，通过氧疗最难纠正的是
A. 弥散功能障碍
B. 肺泡通气量下降
C. 通气/血流比例失衡
D. 肺内分流
E. 氧耗量增加

正确答案：D。肺内分流

解析：肺内分流（D对）是指肺动脉内的静脉血未经氧合直接流入肺静脉，导致PaO₂降低，是通气/血流比例失调的特例，此时通过提高吸氧浓度并不能提高分流静脉血的血氧分压，故通过氧疗最难纠正的是肺内分流。弥散功能障碍（A错）是指O₂，CO₂等气体通过肺泡膜进行交换的物理弥散过程发生障碍，常以低氧血症为主，此时通过氧疗可纠正低氧血症。肺泡通气量下降（B错）可使机体缺氧和CO₂潴留，此时吸入低浓度氧，可缓解机体的低氧血症。通气/血流比例失衡（C错）仅导致机体缺氧，而无CO₂潴留，通过氧疗也可以纠正机体的低氧血症。氧耗量增加（E错）在正常人中，可通过增加通气量来防止缺氧的发生，若伴有通气功能障碍，可发生低氧血症，此时通过氧疗也可以纠正机体的低氧血症。